某患者，女，82岁，牙列缺失，牙槽嵴狭窄，全口义齿修复后咀嚼效率低，其原因不可能是
A. 年龄过大
B. 牙槽嵴狭窄，固位较差
C. 垂直距离过低
D. 咬合接触点少
E. 人工牙型号选择过小

正确答案：A。年龄过大

解析：本题考查咀嚼效率低的原因。咀嚼效率与患者的年龄（A错，为本题的正确答案）无直接相关联系。全口义齿修复后咀嚼效率的高低与牙槽骨的丰满度、义齿固位力、义齿垂直距离的高低、咬合接触面积、人工牙的型号大小均有关，牙槽骨越狭窄、固位力越差（B对）、垂直距离过高或过低（C对）、咬合接触面积越小（D对）修复后咀嚼效率越低，其中人工牙型号选择越小（E对），咬合接触面积越小。